四环素类药物的首选药是
A. 多西环素
B. 米诺环素
C. 红霉素
D. 林可霉素
E. 青霉素

正确答案：A。多西环素

解析：由于耐药菌株日益增多和药物的不良反应，四环素一般不作首选药。使用本类药物时首选多西环素。掌握“四环素、多西环素及米诺环素”知识点。